男，68岁，双侧肾动脉狭窄，有哮喘史，气短、心悸就诊，体征和实验结果为血压172/96mmHg，血尿酸516mmol/L（正常180～440），血钾110mmol/L（正常为25～100），应该选哪个抗高血压药
A. 氢氯噻嗪
B. 替米沙坦
C. 卡托普利
D. 利血平
E. 拉西地平

正确答案：E。拉西地平

解析：本题考查抗高血压药。拉西地平（E对）属于二氢吡啶类钙通道阻滞剂，钙通道阻滞剂适用于老年高血压，单纯收缩期高血压，伴稳定型心绞痛、冠状动脉或颈动脉粥样硬化及周围血管疾病患者。题干中患者68岁可判断为老年高血压。氢氯噻嗪（A错）禁用于高尿酸患者。替米沙坦（B错）为血管紧张素Ⅱ受体拮抗药，禁用于双侧肾动脉狭窄患者。卡托普利（C错）为血管紧张素转换酶抑制药，禁用于双侧肾动脉狭窄患者。利血平（D错）慎用于高尿酸血症患者。